某山村儿童牙齿有黄斑的人数增多，应做何种进一步检查
A. 尿镉
B. 尿铅
C. 尿氟
D. 头发汞
E. 血铅

正确答案：C。尿氟

解析：本题考查氟对牙齿的影响。牙齿黄斑是一种常见的牙病，主要发生在儿童，特别是山村儿童更容易受到影响。牙齿黄斑是由于氟化物积累而导致的，氟化物可以通过水和食物的摄入而被人体吸收，存在于人体的某些组织和液体中，尤其是尿液中。由于氟化物是一种无色无味的物质，所以只能通过化验检测其存在。因此，采用尿氟（C对ABDE错）检查来诊断牙齿黄斑是最准确的方法。